附子与干姜均可治疗的病证是
A. 亡阳暴脱，四肢厥逆
B. 元气暴脱，虚汗脉微
C. 肾阳不足，畏寒肢冷
D. 气虚不足，倦怠乏力
E. 神志昏迷，不省人事

正确答案：A。亡阳暴脱，四肢厥逆

解析：附子的功效为回阳救逆，补火助阳，散寒止痛。可用于治疗亡阳虚脱，肢冷脉微；肾阳虚衰、阳痿宫冷，虚寒吐泻、脘腹冷痛，阴寒水肿，心阳不足、胸痹冷痛，阳虚外感；寒湿痹痛。干姜的功效为温中散寒，回阳通脉，温肺化饮。可用于治疗脾胃寒证，脘腹冷痛，呕吐泄泻；亡阳证，肢冷脉微；寒饮喘咳。两药均可用于治疗亡阳暴脱，四肢厥逆（A对）。